在物理灭菌方法中，为首选的是
A. 紫外线消毒
B. 辐射消毒
C. 酒精消毒
D. 高压消毒
E. 热力消毒

正确答案：E。热力消毒

解析：热力灭菌效果可靠又简单，为首选的灭菌方法。掌握“消毒与灭菌”知识点。